免疫调理作用最强的Ig是
A. IgG
B. IgM
C. lgA
D. IgD
E. IgE

正确答案：A。IgG